川木通的性状特征是
A. 呈长圆锥形，皮孔明显
B. 表面有纵向凹沟及棱线，节多膨大，残余皮部易撕裂
C. 质坚硬，不易折断
D. 横切面边缘不整齐，有黄白色放射状纹理及裂隙，其间布满导管孔
E. 气特异，味苦

正确答案：B、C、D。表面有纵向凹沟及棱线，节多膨大，残余皮部易撕裂；质坚硬，不易折断；横切面边缘不整齐，有黄白色放射状纹理及裂隙，其间布满导管孔